分子中含有酸性的四氮唑基团，可与氨氯地平组成复方用于治疗原发性高血压的药物是
A. 对乙酰氨基酚
B. 舒林酸
C. 赖诺普利
D. 缬沙坦
E. 氢氯噻嗪

正确答案：D。缬沙坦

解析：本题考查缬沙坦。分子中含有酸性的四氮唑基团，可与氨氯地平组成复方用于治疗原发性高血压的药物是缬沙坦（D对）。对乙酰氨基酚（A错）为解热镇痛药、非甾体抗炎药。舒林酸（B错）为非甾体抗炎药。赖诺普利（C错）具有两个没被酯化的羧基，且赖诺普利和卡托普利是当前唯一使用的两个非前药的ACE抑制剂。氢氯噻嗪（E错）属于噻嗪类利尿药。